下列各项，不属三有余，四不足小儿生理病理学说的是
A. 肺常不足
B. 脾常不足
C. 心常不足
D. 阴常不足
E. 肾常不足

正确答案：C。心常不足

解析：万全在总结钱乙五脏虚实辨证的基础上，结合个人临床实践体会，进一步完善了小儿生理病理学理论，他提出了“三有余、四不足”之说，即肝常有余、心常有余（C错，为本题正确答案）、阳常有余，脾常不足（B对）、肺常不足（A对）、肾常虚（E对）、阴常不足（D对）。